下丘脑促性腺激素释放激素的分泌调控中超短反馈是指
A. 卵巢性激素对下丘脑-垂体的反馈作用
B. 垂体激素对下丘脑的负反馈
C. 促性腺激素释放激素对其本身合成、分泌的抑制
D. 腺垂体对GnRH的脉冲式刺激起反应
E. 卵巢性激素对下丘脑GnRH和FSH、LH合成和分泌具有反馈作用

正确答案：C。促性腺激素释放激素对其本身合成、分泌的抑制

解析：短反馈是指垂体激素对下丘脑的负反馈；超短反馈是指促性腺激素释放激素对其本身合成、分泌的抑制。掌握“女性生殖系统生理”知识点。